参与再循环的淋巴细胞主要是
A. 成熟T细胞
B. 成熟B细胞
C. 不成熟T细胞
D. 不成熟B细胞
E. 记忆性B细胞

正确答案：A。成熟T细胞